患者项背强急，四肢抽搐，角弓反张，发热不恶寒，头痛汗出，舌苔薄白，脉沉细。治疗应首选
A. 羌活胜湿汤
B. 增液承气汤
C. 栝蒌桂枝汤
D. 天麻钩藤饮
E. 大定风珠

正确答案：C。栝蒌桂枝汤

解析：风邪兼夹寒湿，阻滞经络，故项背强急，头痛；风邪偏盛，引动肝风，故四肢抽搐，角弓反张；风为阳邪，其性主泄，侵袭体表，肌腠开阖，故发热不恶寒，汗出；舌苔薄白，脉沉细，为邪阻经脉,营卫运行不利及津液不足筋脉失养之征，故证属柔痉，治以和营养阴，代表方为栝蒌桂枝汤（C对）。羌活胜湿汤，其功用为祛风，胜湿，止痛，可用于痉证之邪壅经络证（A错）。增液承气汤，其功用为滋阴增液，泻热通便，与白虎汤合用，可用于治疗痉证之阳明热盛证(B错)。天麻钩藤饮，其功用为平肝熄风，清热活血，补益肝肾，适用于治疗内伤头痛之肝阳头痛（D错）。大定风珠，其功用为滋阴熄风，与四物汤合用，可用于治疗阴血亏虚证（E错）。